最常见的引起变应性接触性皮炎的化妆品是
A. 防晒剂
B. 唇膏
C. 香水
D. 染发剂
E. 指甲油

正确答案：C。香水